导致生殖道尖锐湿疣并且与宫颈癌发病有关的病原体是
A. 苍白密螺旋体
B. 淋病奈瑟菌
C. 人乳头瘤病毒
D. 沙眼衣原体
E. 单纯疱疹病毒

正确答案：C。人乳头瘤病毒

解析：尖锐湿疣是由人乳头瘤病毒所致常发生在肛门及外生殖器等部位，主要通过性行为传染。人是人类乳头瘤病毒的唯一宿主。目前采用分子生物学技术将HPV分为100多种亚型，引起尖锐湿疣的病毒主要是HPV-6、11、16、18等型。HPV主要感染上皮组织，HPV-16、18、45、56型最常见的致宫颈癌高危型。因此，导致生殖道尖锐湿疣并且与宫颈癌发病有关的病原体是人乳头瘤病毒（C对）。梅毒螺旋体通常不易着色，故又称苍白螺旋体（A错）。梅毒是由梅毒螺旋体引起的一种慢性传染病，主要通过性接触和血液传播（P221）。淋病由淋病奈瑟菌（B错）感染引起，主要表现为泌尿生殖系统的化脓性感染，也可导致眼、咽、直肠感染和播散性淋球菌感染（P227）。性病性淋巴肉芽肿，又称第四性病，由沙眼衣原体（D错）引起（P235）。生殖器疱疹是由单纯疱疹病毒（E错）感染泌尿生殖器及肛周皮肤黏膜而引起的一种慢性、复发性、难治愈的STD（P232）。